中药炮制的目的有
A. 降低药物的毒副作用
B. 增强药物疗效
C. 缓和药物性能
D. 改变或增强药物作用趋向
E. 便于调剂

正确答案：A、B、C、D、E。降低药物的毒副作用；增强药物疗效；缓和药物性能；改变或增强药物作用趋向；便于调剂

解析：本题考查的是中药炮制的目的。中药炮制的目的有降低药物的毒副作用（A对）、增强药物疗效（B对）、缓和药物性能（C对）、改变或增强药物作用趋向（D对）与便于调剂（E对）。中药炮制的目的有：1.降低或消除药物的毒性或副作用；2.改变或缓和药物的性能；3.增强药物疗效；4.便于调剂和制剂；5.提高中药净度，确保用药质量和剂量。炮制对升降浮沉的影响：炮制可增强药物的作用趋向；炮制可改变药物作用趋向。